A人群和B人群的冠心病粗死亡率都为4‰，A人群年龄校正死亡率5‰，B人群为3‰，因此可以得出结论
A. A人群的年轻人多于B人群
B. A人群的年老人多于B人群
C. 两人群的年龄分布一致
D. A人群的诊断比B人群准确
E. A人群的诊断没有B人群准确

正确答案：A。A人群的年轻人多于B人群

解析：本题考查率的标准化的应用。两个地区有相等的粗死亡率，经过率的标准化后，A人群死亡率高于B人群，说明B人群中，死亡率高的人群（年龄大）占比较大，因此进行率的标准化时，这部分因素被削弱，导致标化死亡率低于A地区。因此A人群的年轻人多于B人群（A对BCDE错）。